小儿哮喘发作的病机是
A. 肺气郁闭
B. 娇邪夹痰饮伏留肺络
C. 痰气交阻，肺气郁闭
D. 外因诱发，触动伏痰，痰阻气道
E. 肺失宣降，肺气上逆

正确答案：D。外因诱发，触动伏痰，痰阻气道

解析：哮喘发病即有外因，又有内因，内因责之于素体肺、脾、肾三脏不足，痰饮留伏；外因责之于感触外邪（接触异物、异味、嗜食咸酸、情志刺激及劳倦等），其病机为外因诱发，触动伏痰，痰随气升，气因痰阻，相互搏结，阻塞气道（D对BC错）。肺气郁闭（A错）为肺炎喘嗽的病机。肺失宣降，肺气上逆（E错）为喘证之虚喘的病机之一。